频数分布的两个重要特征是
A. 统计量与参数
B. 样本均数与总体均数
C. 集中趋势与离散趋势
D. 样本标准差与总体标准差
E. 集中趋势与标准差

正确答案：C。集中趋势与离散趋势

解析：频数分布的两个重要特征是集中趋势与离散趋势（C对）。统计量与参数（A错）（总体）之间的差异叫做抽样误差。样本均数与总体均数（B错）的差异一般见于抽样误差。样本标准差是用数据算出来的，只要有测量数据就可以计算，而总体的标准差要通过概率密度才能求出来，一般是做不到的，因为在数理统计中，总体的分布一般是未知的。样本的标准差是总体标准差的近似（DE错）。